六神丸除化腐止痛外，又能
A. 清热解毒，开音
B. 清热解毒，敛疮
C. 清热解毒，消肿利咽
D. 清热利咽，生津润燥
E. 清热滋阴

正确答案：C。清热解毒，消肿利咽

解析：本题考查的是六神丸的功能。六神丸除化腐止痛外，又能清热解毒，消肿利咽（C对）。六神丸：【功能】清热解毒，消肿利咽，化腐止痛。清音丸：【功能】清热利咽，生津润燥（D错）。玄麦甘桔含片：【功能】清热滋阴（E错），祛痰利咽。功能为清热解毒，开音（A错）与清热解毒，敛疮（B错）的中成药，2022年考试指南未明确说明。